高容量性低钠血症最常发生于
A. 用无盐水灌肠
B. 急性肾功能不全患者而又补液不恰当时
C. 精神性饮水
D. 持续大量饮水
E. ADH分泌过多

正确答案：B。急性肾功能不全患者而又补液不恰当时

解析：高容量性低钠血症最常发生于急性肾功能不全患者而又补液不恰当时（B对）。用无盐水灌肠（A错）、精神性饮水（C错）、持续大量饮水（D错）、ADH分泌过多（E错）均会导致高容量性低钠血症，但不是最常见原因。